心动周期持续的时间长短与之相关
A. 心房收缩时程
B. 心房舒张时程
C. 心室收缩时程
D. 心室舒张时程
E. 心率

正确答案：E。心率